最常见的颌骨上皮性牙源性肿瘤为
A. 成釉细胞瘤
B. 多形性腺瘤
C. 血管瘤
D. 角化囊肿
E. 淋巴管瘤

正确答案：A。成釉细胞瘤

解析：本题考查牙源性肿瘤-成釉细胞瘤。最常见的颌骨上皮性牙源性肿瘤为成釉细胞瘤（A对）。1.成釉细胞瘤为颌骨中心性上皮肿瘤，在牙源性肿瘤中较为常见。2.多形性腺瘤（B错）由肿瘤性上皮组织和黏液样或软骨样间质所组成，根据其成分比例，可分为细胞丰富型及间质丰富型。一般认为，细胞丰富型相对较易恶变，间质丰富型相对较易复发。3.血管瘤（C错）是婴幼儿最常见的血管源性良性肿瘤，多见于婴儿出生时（约1/3）或出生后1个月之内。4.牙源性角化囊肿（D错）是一种内衬不全角化的复层鳞状上皮，具有潜在侵袭性的牙源性囊肿。5.淋巴管畸形过去称为淋巴管瘤（E错），是淋巴系统的发育畸形。根据临床特征和组织学结构分为微囊型和大囊型两类。